男性，35岁。1年来反复出现腹泻，粪便糊状，结肠镜检查发现病变主要位于回肠末端，表现为多发的纵行溃疡，溃疡间黏膜正常，最可能的诊断是
A. 结肠癌
B. 溃疡性结肠炎
C. 细菌性痢疾
D. 克罗恩病
E. 肠结核

正确答案：D。克罗恩病

解析：中年男性患者，1年来反复腹泻，粪便糊状（符合克罗恩病的临床表现）。结肠镜：回肠末段（克罗恩病的好发部位）多发的纵行溃疡，溃疡间黏膜正常（克罗恩病的结肠镜表现为纵行溃疡和裂隙溃疡、鹅卵石征，病变间的黏膜正常）。综合该患者的病史、结肠镜检查，考虑诊断为克罗恩病（D对）。结肠癌（P382）（A错）发病年龄多在40～60岁，好发于直肠，多表现为鲜血便，直肠镜检可见火山状溃疡。溃疡性结肠炎（P374）（B错）临床以反复发作的腹泻、黏液脓血便、左下腹或下腹阵痛为特征，结肠镜下可见黏膜充血水肿，弥漫性糜烂和多发性浅溃疡形成。细菌性痢疾（C错）常表现为里急后重，黏液脓血便，结肠镜下可见地图状溃疡。肠结核（E错）多有低热、盗汗、乏力等结核中毒症状，结肠镜下可见回盲部带状溃疡、炎性息肉、肠腔环形狭窄。